关于腹膜的叙述错误的是
A. 衬于腹、盆壁的内面和腹、盆腔脏器的表面
B. 分为脏层和壁层
C. 由间皮和少量结缔组织构成
D. 呈半透明为一层薄而光滑的纤维膜
E. 无

正确答案：D。呈半透明为一层薄而光滑的纤维膜

解析：腹膜是衬于腹、盆壁的内面和腹、盆腔脏器的表面（A对）的一层薄而光滑的浆膜,呈半透明状，分为脏层和壁层（B对），浆膜由结缔组织和表面间皮组成（C对，故D为本题正确答案）